下列说法中哪项是正确的
A. 甲型肝炎的潜伏期为15～80天
B. 乙型肝炎的平均潜伏期为1个月
C. 丙型肝炎的最长潜伏期为1个月
D. 丁型肝炎的潜伏期为2～4周
E. 戊型肝炎的平均潜伏期为40天

正确答案：E。戊型肝炎的平均潜伏期为40天

解析：本题考查病毒性肝炎的潜伏期。戊肝的潜伏期为10～60天，平均40天（E对）；甲肝的潜伏期为15～50天（A错），平均为30天；乙肝的潜伏期一般为30～120天，平均60～90天（B错）；丙肝的潜伏期为2～26周（C错）；丁肝的潜伏期为1～6个月（D错）。